体积最大、数目最少的乳头是
A. 丝状乳头
B. 菌状乳头
C. 轮廓乳头
D. 叶状乳头
E. 以上都不是

正确答案：C。轮廓乳头

解析：本题考查口腔黏膜分类及组织结构。轮廓乳头（C对）：在舌乳头中体积最大，数目最少。约10个左右，沿界沟的前方排列成一行。在乳头的环沟侧壁上皮内，有许多染色浅淡的卵圆形小体，称味蕾，有感受味觉的功能。